肾脏是药物代谢和排泄的重要器官，肾功能不全时药物代谢和排泄均会受到影响，导致药物蓄积而加重肾脏损害，故肾功能不全者用药时的注意事项有
A. 忌用有肾毒性的药物
B. 注意药物相互作用
C. 坚持少而精的用药原则
D. 定期检查及时调整治疗方案
E. 坚持以疾病是否治愈作为判断终点

正确答案：A、B、C、D。忌用有肾毒性的药物；注意药物相互作用；坚持少而精的用药原则；定期检查及时调整治疗方案

解析：本题考查的是肾功能不全者用药基本原则和注意事项。肾功能不全者用药时的注意事项有忌用有肾毒性的药物（A对）、注意药物相互作用（B对）、坚持少而精的用药原则（C对）与定期检查及时调整治疗方案（D对）。肾功能不全者用药基本原则和注意事项：1.明确疾病诊断和治疗目标；2.忌用有肾毒性的药物；3.注意药物相互作用，避免产生新的肾损害；4.坚持少而精的用药原则；5.定期检查，及时调整治疗方案。